与振动病发病率高低有密切关系的振动参数是
A. 频率
B. 加速度
C. 接触振动的时间
D. 工作体位和操作方式
E. 工作环境的气温

正确答案：B。加速度